男，27岁，牙龈疼痛，自动出血3天。检查：腐败性口臭，多个牙的牙龈乳头尖端消失变平，下切牙的龈缘虫蚀状坏死，有灰白膜覆盖。该病的最可能诊断是急性坏死性龈炎，对诊断最有帮助的辅助检查是
A. 涂片革兰染色
B. 查白细胞
C. 拍曲面断层片
D. 咬合检查
E. 肌电图检查

正确答案：A。涂片革兰染色

解析：本题考查急性坏死性溃疡性龈炎的辅助检查。急性坏死性龈炎是一种由多种微生物引起的机会性感染，主要由梭形杆菌和螺旋体引起。在病变区涂片革兰染色（A对）检查可见大量梭形杆菌和螺旋体与坏死组织及其他细菌混杂，这有助于本病的诊断。查白细胞（B错）有助于检查白血病，排除该病例中由白血病引起的自发性出血的情况，但不是最有帮助的辅助检查。拍曲面断层片（C错）主要观察硬组织结构的影响，急性坏死性龈炎为软组织的疾病，X片上观察不到有明显意义的信息。咬合检查（D错）主要检查牙合关系，对急性坏死性龈炎的诊断没帮助。肌电图检查（E错）主要用于确定周围神经、神经元、神经肌肉接头及肌肉本身的功能状态，与急性坏死性龈炎无关。